男，38岁。反复发作肉眼血尿8年，均在上呼吸道感染后1～2天出现。发作间期多次查尿常规示蛋白（+～++），沉渣镜检RBC8～10/HP，双下肢无水肿。尿蛋白定量0.8g/d，肾功能正常。该患者临床诊断为
A. 高血压肾损害
B. 无症状性血尿和蛋白尿
C. 慢性间质性肾炎
D. 慢性肾小球肾炎
E. 肾病综合征

正确答案：B。无症状性血尿和蛋白尿

解析：患者中年男性，反复发作肉眼血尿8年，均在上呼吸道感染后出现。尿常规示蛋白（+～++），尿蛋白定量0.8g/d（正常值定性：阴性；定量0～80mg/24h），沉渣镜检RBC8～10/HP（正常值平均0～3个/Hp），双下肢无水肿，肾功能正常。无症状性血尿或（和）蛋白尿（B对）无水肿、高血压及肾功能损害，而仅表现为肾小球源性血尿或（和）蛋白尿。高血压肾损害（A错）、慢性间质性肾炎（C错）、慢性肾小球肾炎（D错）、肾病综合征（E错）均有肾功能异常。